患者女，58岁，牙列缺失，要求修复。帮助患者的下颌自然回到正中关系位时，下列哪种方法不正确
A. 哥特式弓描记法
B. 面部外形观察法
C. 卷舌后舔法
D. 后牙咬合法
E. 肌监控仪法

正确答案：B。面部外形观察法

解析：本题考查无牙颌的印模与模型。面部外形观察法（B错，为本题正确答案）可在确定垂直距离的时候作为参考。